男性，29岁，大量饮酒后呕吐鲜血一小时，量约800ml，查体：P:110次/分，血压：92/65mmHg，神志清楚，未见肝掌，蜘蛛痣，腹软，无压痛，肝脾肋下未触及，肠鸣音12次/分，为明确诊断最有意义的检查
A. 腹部CT
B. 上消化道X线钡餐造影
C. 腹部X线平片
D. 腹部B超
E. 胃镜

正确答案：E。胃镜

解析：患者男性，29岁，大量饮酒后呕吐鲜血（上消化道出血的特征表现），查体：P:110次/分（正常范围：60～100次/分，高于正常值，出现心动过速），血压：92 /65mmHg，神志清楚，未见肝掌，蜘蛛痣（排除肝硬化），腹软，无压痛（无胃肠穿孔表现），肝脾肋下未触及，肠鸣音12次/分(正常值：4～5次/分，肠鸣音亢进，可能患有消化道大出血），结合患者的情况，明确诊断最有意义的检查是行胃镜检查，它是诊断上消化道出血和下消化道出血病因、部位和出血情况的首选方法（E对）。